对于所谓久病成医者，最适合采用何种模式
A. 主动-被动型
B. 指导-合作型
C. 共同参与型
D. 教士模式
E. 工程模式

正确答案：C。共同参与型

解析：对于所谓久病成医者，最适合采用何种模式共同参与型，在这种模式中，医患双方共同参与医疗方案的讨论、制订与分享。这种模式适用于具有一定医学知识背景或长期的慢性病患者，它类似于成人与成人之间的关系，医生的责任是“帮助患者自疗”（C对DE错）。主动-被动型是医患双方不是双向作用，而是医生对患者单向发生作用。这样有益于发挥医生的积极性（A错）。指导-合作模式 在这种模式中，患者被看作有意识、有思想的人，具有一定的主动性，能够主动述说病情，反映诊治情况，配合检查和治疗（B错）。